血溢脉外，称
A. 血虚
B. 血热
C. 血瘀
D. 血寒
E. 出血

正确答案：E。出血

解析：本题考查的是血失调。血溢脉外，称出血（E对）。血失调，是指血虚和血行失常的病变变化。（1）血虚（A错）：血虚，是指血液不足或血的濡养功能减退的病机变化。失血过多，新血来不及生成，或脾胃虚弱，饮食营养不足，化生血液的功能减弱或化源不足，而致血液化生障碍，或因久病不愈、慢性消耗等因素而致营血暗耗等，均可导致血虚。全身各脏腑、经络等组织器官，都依赖于血的濡养。在血虚时，就会出现全身或局部的失荣失养，功能活动逐渐衰退等虚弱的证候。例如，面色不华，唇舌爪甲色淡无华，头目眩晕，心悸怔忡，神疲乏力，形体瘦怯，或手足麻木，关节屈伸不利，或两目干涩，视物昏花等。血不足在女子最为多见，多与月经、胎孕、分娩、哺乳等密切相关，可引发月经量少，或经闭，或不孕，或乳少，或产子多羸弱。（2）出血：出血，是指血液不循常道，流出脉外的病机变化。原因有外伤出血、气虚失血、血热妄行等。出血有咯血、吐血、衄血、便血、尿血、皮下出血（紫癜）、崩漏、创伤出血等，有的出血可排出体外，有的则渗溢于体腔之内或肌肤之中形成瘀血。（3）血瘀（C错）：血瘀，是指血液的循行迟缓和不流畅的病机变化。气滞血行受阻，或气虚血运迟缓，或痰浊阻于脉络，或寒邪入血，或邪热煎熬血液等，均可形成血瘀，甚则血液瘀结而成瘀血。因此常可兼夹寒、热、痰、气滞，而形成寒凝血瘀、瘀热互结、痰瘀交阻、气滞血瘀等病证。血瘀可出现于不同部位，各有其特征。血热（B错）证的临床表现及辨证要点：血热证的临床表现，常见心烦，或躁扰发狂，口干不喜饮，身热，以夜间为甚，脉细数，舌红绛，或见各种出血证，妇女月经先期、量多等。一般以出血和全身热象为辨证要点。血寒（D错）证的临床表现及辨证要点：血寒证的临床表现，常见疼痛喜暖，得暖痛减，形寒肢冷，舌淡而暗，脉沉迟涩。妇女常见少腹冷痛，畏寒肢冷，月经愆期，经色暗淡有血块等症。一般以手足、腹部等局部冷痛，肤色紫暗为辨证要点。